通过阻滞钙通道，抑制钙内流而降低血压的药物是
A. 缬沙坦
B. 氨氯地平
C. 依那普利
D. 可乐定
E. 二氮嗪

正确答案：B。氨氯地平

解析：本题考查氨氯地平。通过阻滞钙通道，抑制钙内流而降低血压的药物是氨氯地平（B对）。氨氯地平为钙通道阻滞药，钙通道阻滞药能选择性地阻断电压门控性Ca²⁺通道，抑制细胞外Ca²⁺内流，松弛血管平滑肌，降低外周血管阻力，使血压下降。缬沙坦（A错）为血管紧张素Ⅱ受体阻断剂（ARB）。依那普利（C错）属于血管紧张素转换酶抑制剂（ACEI）。可乐定（D错）为中枢降压药。二氮嗪（E错）是一种无利尿作用的苯噻嗪类速效降压药，直接作用于血管平滑肌，降低外周血管阻力，使血压急剧下降。